长期大量使用可引起肝损害及维生素缺乏的是
A. 红霉素
B. 罗红霉素
C. 克拉霉素
D. 克林霉素
E. 四环素

正确答案：E。四环素

解析：本题考查四环素的不良反应。四环素（E对）可致肠道菌群失调，维生素缺乏，长期使用可能发生肝毒性。红霉素（A错）、罗红霉素（B错）、克拉霉素（C错）的不良反应主要为胃肠道反应。克林霉素（D错）的不良反应有恶心、呕吐、食欲不振、腹胀、腹泻、皮疹、白细胞减少、转氨酶升高等。